下列属于扩张型心肌病特征的是
A. 主要表现为舒张功能障碍
B. 为伴有特异系统性疾病的心肌病
C. 心腔扩大，室壁运动普遍减弱
D. 心室充盈受限和舒张期容量下降
E. 右室心肌被纤维脂肪组织所替代

正确答案：C。心腔扩大，室壁运动普遍减弱

解析：扩张型心肌病是一类以左心室或双心室扩大伴收缩功能障碍为特征的心肌病。超声心动图显示心腔均扩大，室壁运动普遍减弱（C对），心肌收缩功能下降（A错）。伴有特异系统性疾病的心肌病（B错）即特异性心肌病，如缺血性心肌病、瓣膜性心肌病、高血压心肌病等，而扩张型心肌病病因不明，属于原发性心肌病。心室充盈受限和舒张期容量下降（D错）和右室心肌被纤维脂肪组织所替代（E错）都为限制型心肌病（P269）的特点。